女性，60岁。发现主动脉瓣狭窄10年，快走时心前区憋闷3年．心电图示左心室肥厚，该患者治疗宜首选
A. 主动脉瓣瓣膜置换术
B. 主动脉瓣球囊成形术
C. 心脏移植
D. 冠状动脉搭桥术
E. 主动脉瓣修补术

正确答案：A。主动脉瓣瓣膜置换术

解析：患者为中老年女性，发现主动脉瓣狭窄10年，有行走时心前区憋闷史，左心室肥厚，提示患者已有临床症状，因此该患者治疗宜首选主动脉瓣瓣膜置换术（A对）。主动脉瓣球囊成形术（B错）有创伤小、耗资低等优点，但是不能降低远期死亡率，且临床应用范围局限，主要用于治疗高龄、有心力衰竭等手术的高危患者。心脏移植（C错）适用于各种原因导致的心功能衰竭的终末状态，不适合本例患者。冠状动脉搭桥术（D错）急性心肌梗死多支血管病变患者。主动脉瓣修补术（P300）（E错）主要用于创伤、感染性心内膜炎所致瓣叶穿孔的患者。